《中华人民共和国广告法》规定，药品和医疗器械广告不得含有
A. 说明治愈率或有效率的
B. 利用医生、患者的形象作证明的
C. 与其他药品、医疗器械的功效和安全性比较的
D. 使用统计资料、调查结果、文摘等证明其功效的
E. 利用医药科研机构、医疗机构名义作证明的

正确答案：A、B、C、E。说明治愈率或有效率的；利用医生、患者的形象作证明的；与其他药品、医疗器械的功效和安全性比较的；利用医药科研机构、医疗机构名义作证明的

解析：本题考查《中华人民共和国广告法》。根据《中华人民共和国广告法》第十六条的规定，医疗、药品、医疗器械广告不得含有下列内容：（一）表示功效、安全性的断言或者保证；（二）说明治愈率或者有效率（A对）；（三）与其他药品、医疗器械的功效和安全性或者其他医疗机构比较（C对）；（四）利用医药科研单位、学术机构、医疗机构（E对）或者专家、医生、患者的名义和形象（B对）作证明的；（五）法律、行政法规规定禁止的其他内容。